女，35岁。妊娠35+2周，2周前血压升高至160/100mmHg，未治疗。现突然持续性腹痛、逐渐加重，感头晕、恶心、阴道有少量流血。查体：T36.8℃，P120次/分，BP100/60mmHg，呼吸急促。面色苍白，腹部隆起，板状腹，胎方位不清，未闻及胎心。最可能的诊断是
A. 胎盘早剥
B. 早产临产
C. 妊娠合并急性胰腺炎
D. 临产伴急性阑尾炎
E. 先兆子宫破裂

正确答案：A。胎盘早剥

解析：患者妊娠35+2周，2周前血压升高至160/100mmHg（胎盘早剥危险因素），未治疗，现突然持续性腹痛、逐渐加重，阴道有少量流血（胎盘早剥典型症状），P120次/分，BP100/60mmHg，呼吸急促。面色苍白，腹部隆起，板状腹，胎方位不清，未闻及胎心（胎盘早剥典型体征）。综合患者的症状、体征和辅助检查，最可能诊断为胎盘早剥（A对）。早产临产（B错）、妊娠合并急性胰腺炎（C错）不会出现胎方位不清，未闻及胎心表现。先兆子宫破裂（E错）常见于产程长、有梗阻性难产因素的产妇，主要表现为子宫呈强直性或痉挛性过强收缩，下腹剧痛难忍。